肝硬化的重要实验室诊断依据是
A. ALT升高
B. 清蛋白下降及A/G比值倒置
C. 血糖减少
D. 胆红素增高
E. ALP升高

正确答案：B。清蛋白下降及A/G比值倒置